某女，45岁。咳嗽月余，症见咽喉干痛、干咳少痰，时而痰中带血，宜选用的中成药是
A. 强力枇杷露
B. 急支糖浆
C. 桂龙咳喘宁胶囊
D. 苏子降气丸
E. 养阴清肺膏

正确答案：E。养阴清肺膏

解析：本题考查的是养阴清肺膏的主治。咳嗽月余，症见咽喉干痛、干咳少痰，时而痰中带血，宜选用的中成药是养阴清肺膏（E对）。养阴清肺膏：【主治】阴虚燥咳，咽喉干痛，干咳少痰，或痰中带血。强力枇杷露（A错）：【主治】痰热伤肺所致的咳嗽经久不愈、痰少而黄或干咳无痰；急、慢性支气管炎见上述证候者。急支糖浆（B错）：【主治】外感风热所致的咳嗽，症见发热、恶寒、胸膈满闷、咳嗽咽痛；急性支气管炎、慢性支气管炎急性发作见上述证候者。桂龙咳喘宁胶囊（C错）：【主治】外感风寒，痰湿内阻引起的咳嗽、气喘、痰涎壅盛；急、慢性支气管炎见上述证候者。苏子降气丸（D错）：【主治】上盛下虚、气逆痰壅所致的咳嗽喘息、胸膈满闷。